咳嗽伴有低热、盗汗、咯血多见于
A. 上呼吸道感染
B. 胸膜炎
C. 喉头水肿
D. 支气管扩张
E. 肺结核

正确答案：E。肺结核

解析：咳嗽、咳痰、痰中带血或咯血、乏力、低热、盗汗为肺结核的主要表现（E对）。上呼吸道感染（P13）（A错）主要表现为发热、咳嗽、喷嚏、咽痛等。胸膜炎（B错）主要表现为胸痛、胸闷、咳嗽、气急、呼吸困难等。喉头水肿（C错）主要表现为喉痛、声嘶、喉喘鸣和呼吸困难等。支气管扩张（P38）（D错）主要表现为咳嗽、咳痰及反复咯血，部分患者可伴有杵状指。